我国颁发了《中华人民共和国环境影响评价法》的年份是
A. 1999
B. 2000
C. 2001
D. 2002
E. 2003

正确答案：D。2002

解析：本题考查我国颁发了《中华人民共和国环境影响评价法》的年份。我国于2002（D对ABCE错）年10月28日颁发了《中华人民共和国环境影响评价法》。